晶状体
A. 位于角膜和玻璃体之间
B. 前面曲度大，后面曲度小
C. 晶状体实质周围部称晶状体囊
D. 晶状体实质中央部称晶状体核
E. 无

正确答案：D。晶状体实质中央部称晶状体核

解析：晶状体位于虹膜和玻璃体之间（A错），而非角膜和玻璃体之间，前面曲度较小，后面曲度较大（B错），而非前面曲度大，后面曲度小。晶状体囊是晶状体外面包绕的高度弹性的薄膜（C错），而非晶状体实质周围部。晶状体实质周围部较软，称晶状体皮质；晶状体实质中央部较硬，称晶状体核（D对）。